黄体酮的鉴别方法有
A. 与三氯化铁的反应
B. 与亚硝酸钠的反应
C. 与亚硝基铁氰化钠的反应
D. 与异烟肼的反应
E. 红外分光光度法

正确答案：C、D、E。与亚硝基铁氰化钠的反应；与异烟肼的反应；红外分光光度法